下列疾病中属于心身疾病的是
A. 精神分裂症
B. 抑郁症
C. 消化道溃疡
D. 大叶性肺炎
E. 精神发育迟滞

正确答案：C。消化道溃疡

解析：心身疾病是指心理社会因素在疾病的发生、发展过程中起重要作用的躯体器质性疾病和躯体功能性障碍。消化性溃疡和溃疡性结肠炎是最早被归为心身疾病的（C对），早期的理论认为消化性溃疡的病因是胃酸分泌过多，重大生活事件、长期慢性应激、不良的情绪和人格与消化性溃瘍有关。现代研究证实95%～99%的十二指肠溃疡和70%～90%的胃溃疡与幽门螺杆菌感染有关，目前认为应激可能导致免疫力降低，增加了个体对幽门螺杆菌的易感性。精神分裂症（A错）、抑郁症（B错）、精神发育迟滞（E错）均为异常心理，大叶性肺炎（D错）是由肺炎双球菌等细菌感染引起的呈大叶性分布的肺部急性炎症。